有效防止食物嵌塞的是
A. RPI卡环
B. 回力卡环
C. 联合卡环
D. 对半卡环
E. 杆形卡环

正确答案：C。联合卡环

解析：本题考查卡环的种类及适应证。有效防止食物嵌塞的是联合卡环（C对），也常用于相邻两牙之间有间隙者，联合卡环是由位于相邻两基牙上的2个卡环通过共同的卡环体相连而成，此卡环体位于两基牙的外展隙上，可以有效防止食物嵌塞。RPI卡环（A错）常用于远中游离端义齿，其对基牙无扭力作用，且使基托下组织受力方向近垂直、较均匀。回力卡环（B错）常用于后牙游离端缺失，基牙为前磨牙或尖牙，牙冠较短或锥形，其可减轻基牙承受的力，起到应力中断的作用。对半卡环（D错）常用于前后有缺隙、孤立的前磨牙或磨牙，其固位、稳定作用好。杆形卡环（E错）常用于后牙游离端缺失的末端基牙，其推型固位作用强，可降低游离端义齿加到末端基牙上的扭力。后四者适用于游离端缺失的基牙或孤立的基牙，不存在食物嵌塞的情况。